牙列缺损影响切割磨细食物功能造成
A. 美观的影响
B. 咀嚼功能减退
C. 发音功能障碍
D. 颞下颌关节病变
E. 对牙周组织的影响

正确答案：B。咀嚼功能减退

解析：咀嚼功能减退：部分天然牙的缺失，将影响咀嚼功能，而影响程度与缺牙数量、时间和部位有关。若后牙个别牙缺失，可降低部分咀嚼功能；当上颌或下颌的一侧后牙全部缺失，将丧失一侧食物磨碎功能。若前牙缺失，将影响切割食物功能。个别牙缺失，不及时修复，将会造成邻牙向缺牙区倾斜，缺牙间隙变小，对颌牙伸长引起干扰，从而导致咬合功能紊乱，使牙列的有效功能接触面积相应减少。掌握“牙列缺损病因及影响”知识点。